暑火燥三邪的共同致病特点是
A. 阳邪
B. 炎热
C. 伤津
D. 动血
E. 生风

正确答案：C。伤津

解析：燥性干涩，易伤津、伤肺。暑性升散，易伤津耗气。火热为阳邪，易伤津耗气、生风动血。故综合暑火燥三邪的共同治病特点为伤津（C对ABDE错）。